26岁风湿性心脏病患者，现妊娠45天出现心力衰竭，其处理原则应是
A. 立即行负压吸宫术终止妊娠
B. 控制心力衰竭后继续妊娠
C. 边控制心力衰竭边终止妊娠
D. 控制心力衰竭后行负压吸宫术
E. 控制心力衰竭后行钳刮术

正确答案：D。控制心力衰竭后行负压吸宫术

解析：妊娠合并心脏病时，心衰易发生在32～34周，分娩期及产后3日内（P86），该患者在妊娠45天（不满7周）时就已出现心力衰竭，说明该患者心脏功能不能承受继续妊娠，故应在控制心衰后结束妊娠（ABC错）。负压吸引术适用于孕10周以内者；钳刮术适用于孕周≥10周的早期妊娠（早期妊娠指妊娠第13周末之前）患者，即妊娠10～13周（D对E错）（P383）。